表示药物在体内波动程度的参数是
A. Cmax
B. DF
C. MRT
D. AUMC
E. AUC

正确答案：B。DF

解析：本题考查药动学参数。表示药物在体内波动程度的参数是波动度（DF）（B对）；单室模型血管外途径给药，血药浓度-时间关系为单峰曲线，峰值为峰浓度Cmax（A错）；平均滞留时间（MRT）（C错）是指所有药物分子在体内滞留的平均时间；AUMC（D错）为药-时曲线的一阶矩；AUC（E错）是血药浓度-时间曲线下面积。